过滤水的功效不包括
A. 使滤后水的浊度达到生活饮用水水质标准的要求
B. 去除水中大部分病原体，特别是阿米巴包囊和隐孢子虫卵囊
C. 水经过过滤后残留的微生物失去了悬浮物的保护作用，为滤后消毒创造了条件
D. 可去除水中大部分矿物质
E. 地表水为水源的饮用水净化中，有时可省去沉淀或澄清，但过滤是不可缺少的

正确答案：D。可去除水中大部分矿物质

解析：本题考查过滤的功效。过滤是以石英砂等具有孔隙的粒状滤料层截留水中的杂质从而使水获得澄清的工艺过程。其功效有：①使滤后水的浊度达到生活饮用水水质标准的要求（A对）；②去除水中大部分病原体，如致病菌、病毒以及寄生原虫和蠕虫等，特别是阿米巴包囊和隐孢子虫卵囊对消毒剂的抵抗力很强，主要靠过滤去除（B对）；③水经过滤后，残留微生物失去悬浮物的保护作用，为滤后消毒创造条件（C对）。在以地表水为水源的饮用水净化中，有时可省去沉淀或澄清，但过滤是不可缺少的（E对）。过滤不能去除水中大部分矿物质（D错，为本题正确答案）。